在一项研究某暴露因素和某病的联系的调查中发现：暴露者中发生该病的相对危险度为2.9，据此可推断
A. 暴露者中病死率较高
B. 暴露者中发病率较高
C. 存在该暴露因素可以防止该病的发生
D. 暴露组的发病率为无暴露者的2.9倍
E. 相对危险度为2.9时意义不大

正确答案：D。暴露组的发病率为无暴露者的2.9倍